蛇床子味辛、苦，性温，有小毒，其功效是
A. 杀虫
B. 祛风
C. 燥湿
D. 壮阳
E. 攻毒

正确答案：A、B、C、D。杀虫；祛风；燥湿；壮阳

解析：本题考查的是蛇床子的功效。蛇床子味辛、苦，性温，有小毒，其功效是杀虫（A对）、祛风（B对）、燥湿（C对）与壮阳（D对）。蛇床子：【功效】燥湿祛风，杀虫止痒，温肾壮阳。轻粉：【功效】外用杀虫、攻毒（E错）、敛疮；内服祛痰消积，逐水通便。